男，12岁。1个月前无明显诱因出现左胫骨近端肿痛，逐渐加重，皮肤表面静脉怒张，皮温增高。X线片见左胫骨近端呈溶骨性破坏，伴有骨膜日光放射表现。最可能的诊断是
A. 骨囊肿
B. 骨巨细胞瘤
C. 骨髓炎
D. 骨肉瘤
E. 骨结核

正确答案：D。骨肉瘤

解析：患者为青少年，无明显诱因出现左胫骨近端肿痛，逐渐加重，皮肤表面静脉怒张，皮温增高，X线片见左胫骨近端呈溶骨性破坏，伴有骨膜日光放射状表现（骨肉瘤典型影像学表现），结合患者症状体征和影像学检查，最可能的诊断为左胫骨骨肉瘤（D对）。骨肉瘤好发于青少年股骨远端或胫骨近端的干骺端，主要症状多为持续性局部疼痛，局部静脉怒张、皮温升高，X线表现为溶骨性破坏，可见Codman三角或呈“日光射线”形态。骨囊肿（A错）也好发于青少年长管状骨干骺端，但多无明显症状，X线片表现为干骺端圆形或椭圆形界限清楚的溶骨性病灶。骨巨细胞瘤（B错）好发于20岁～40岁，X线特征性表现为骨端偏心性、溶骨性、囊性破坏而无骨膜反应，病灶呈肥皂泡样改变。骨髓炎（C错）常有高热、呕吐等全身性表现，典型X线表现为骨质破坏和死骨形成。骨结核（E错）多见于脊柱，肱骨近端一般不出现，可有低热、盗汗等结核中毒症状，X线可见区域性骨质疏松和周围少量钙化的骨质破坏病灶。